诱导肿瘤特异性Ag的物质是
A. 人乙肝病毒
B. 甲基胆蒽
C. EB病毒
D. 人乳头瘤病毒
E. 单纯疱疹病毒

正确答案：B。甲基胆蒽